据《灵枢·决气》所述，“液脱”的症状是
A. 脑髓消，屈伸不利
B. 色白，天然不泽
C. 耳聋
D. 目不明
E. 汗大泄

正确答案：A。脑髓消，屈伸不利

解析：《灵枢·决气》：“岐伯曰：精脱者，耳聋（C错）；气脱者，目不明（D错）；津脱者，腠理开，汗大泄（E错）；液脱者，骨属屈伸不利、色夭、脑髓消、胫酸、耳数鸣（A对）；血脱者，色白，夭然不泽（B错）、其脉空虚，此其候也”。